下列关于吞噬细胞吞噬作用的相关叙述中，不正确的说法是
A. 吞噬细胞吞噬病原菌后，有完全和不完全吞噬两种结局
B. 不完全吞噬现象对机体有利
C. 结核分枝杆菌、军团菌属于不完全吞噬
D. 在适应性免疫产生后，不完全吞噬现象可转变为完全吞噬
E. 完全吞噬是病原菌完全被吞噬细胞清理，或杀死

正确答案：B。不完全吞噬现象对机体有利

解析：吞噬细胞吞噬病原菌后，有完全和不完全吞噬两种结局。完全吞噬，指病原菌完全被吞噬细胞清理，或杀死；不完全吞噬，指某些胞内菌（如结核分枝杆菌、军团菌等）及病毒等病原体，只被吞噬细胞吞噬而未被杀死，并被吞噬细胞携带转移，引起病原体扩散至其他器官或组织。不完全吞噬现象对机体不利，可造成病原体隐藏在吞噬细胞内，甚至在其内继续生长繁殖，导致细胞死亡。在适应性免疫产生后，不完全吞噬现象可转变为完全吞噬，例如巨噬细胞功能显著增强后，可促进结核菌隐性感染的康复。掌握“宿主的抗菌免疫及感染的发生发展”知识点。